女，24岁。咽痛2周后出现肉眼血尿，尿RBC满视野，尿蛋白定量0.9g/d.，肾功能及血压正常，ANA（-）。该患者肾活检病理诊断最可能是
A. 膜性肾病
B. 局灶节段性肾小球肾炎
C. 微小病变肾病
D. 毛细血管内增生性肾小球肾炎
E. 膜增生性肾小球肾炎

正确答案：D。毛细血管内增生性肾小球肾炎

解析：患者青年女性，前期有咽痛病史（提示呼吸道感染病史），2周后出现肉眼血尿，尿RBC满视野，尿蛋白定量0.9g/d（正常值≤150mg/d），肾功能及血压正常（排除急进性肾小球肾炎），ANA（-）（排除狼疮肾炎）。患者上呼吸道感染两周后出现血尿及蛋白尿，急性肾炎可能性大，因此病理诊断最可能是毛细血管内增生性肾小球肾炎（D对），增生的细胞以毛细血管丛的系膜细胞和内皮细胞为主。膜性肾病（A错）一般无肉眼血尿。局灶节段性肾小球肾炎（B错）、微小病变肾病（C错）、膜增生性肾小球肾炎（E错）均是肾病综合征的常见病理类型，而非急性肾炎（P466）。